10个月婴儿，呕吐、腹泻2天就诊。大便10次/日，量多，为蛋花汤样，无腥臭味。体检：体温38℃。该患儿可能的初步诊断是
A. 婴儿腹泻
B. 乙型脑炎
C. 中毒型细菌性痢疾
D. 高热惊厥
E. 流脑

正确答案：A。婴儿腹泻